下列哪种疾病不会出现低输出量性心力衰竭？
A. 严重贫血
B. 冠心病
C. 高血压心脏病
D. 心肌病
E. 心脏瓣膜病

正确答案：A。严重贫血

解析：按心排血量高低可把心力衰竭分为低排出量性心力衰竭和高排出量性心力衰竭。冠心病（B错）导致的心肌收缩性降低、高血压性心脏病（C错）及心脏瓣膜病（E错）导致的心室负荷过重、心肌病（D错）导致的心肌收缩性降低或心室舒张充盈受限最终均可使心脏泵功能衰竭，表现为低输出量性心力衰竭。严重贫血（A对）时，外周血管阻力降低，静脉回心血量增加，心脏过度充盈，代偿阶段心排血量明显增加，失代偿时尽管心输出量有所下降，但仍不低于正常人水平，属于高输出量性心力衰竭。